新生儿，诊断为右侧完全性唇、腭裂。腭裂修复术的最佳时间是
A. 患儿6～12个月
B. 患儿12～18个月
C. 患儿2～4岁
D. 患儿4～6岁
E. 患儿6岁以后

正确答案：B。患儿12～18个月

解析：本题考查腭裂修复术的最佳时间。对于腭裂整复术的手术年龄，至今仍存在争议，大致有两种意见，一种使主张约在8～18个月左右手术为宜，另一种意见则认为在5～6岁左右施行为好，目前多数医生以及市面上大量资料都认同8～18个月左右实施手术，因为在此期进行手术，有助于患儿学习说话，也有利于养成正确的发音习惯，此题中12～18个月（B对）在此范围内。患儿6～12个月（A错）不能耐受手术、患儿2～4岁（C错）已过最佳发音期均不适合行腭裂整复术。上海交通大学医学院口腔颌面外科亦认为1岁左右行腭裂整复术，其效果要优于大年龄手术者，所以患儿4～6岁（D错）、患儿6岁以后（E错）均不是行腭裂整复术最佳年龄。